由变量的6个值6，12，14，9，15，20计算中位数可得
A. 3
B. 4
C. 12
D. 13
E. 14

正确答案：D。13

解析：本题考查中位数的相关内容。中位数是一组数据中位于正中位置的数。将所有观测值从小到大顺序排列，中位数将数据一分为二，所有数据中有一半数据比它大，一半数据比它小。n为奇数时，是位于正中间的那个观测值，即第(n+1)/2个观测值，中位数M=X(n+1)/2。n为偶数时，是位于中间的两个观测值，即第n/2和第n/2+1个观测值的均数，即M=½ (xn/2+xn/2+1)。本题从小到大排序依次为6，9，12，14，15，20，n为偶数，则中位数为12+14/2=13（D对ABCE错）。